以下有关磨损的描述中，正确的一项是
A. 是牙齿表面与外物机械性摩擦而产生的牙体组织损耗
B. 可见于刷牙引起的前后牙唇、颊面的非生理性损耗
C. 可见于嗑瓜子造成的上下中切牙切缘的楔形缺损
D. 是非生理学现象
E. 以上均正确

正确答案：E。以上均正确

解析：磨损：—般指牙齿表面与外物机械性摩擦而产生的牙体组织损耗。如刷牙引起的前后牙唇、颊面的非生理性损耗；嗑瓜子造成的上下中切牙切缘的楔形缺损。掌握“牙动度和唇、舌、腭对咀嚼的作用”知识点。